肾性原因引起的低容量性低钠血症晚期
A. 尿量减少，尿钠含量降低
B. 尿量减少，尿钠含量增加
C. 尿量不少，尿钠含量降低
D. 尿量增多，尿钠含量降低
E. 尿量增多，尿钠含量增加

正确答案：B。尿量减少，尿钠含量增加

解析：低渗性脱水时机体循环血量减少导致尿量减少，肾性原因导致低渗性脱水是由于肾重吸收钠减少，故尿钠含量增加（B对）。尿量增多，尿钠含量降低（D错）见于肾外原因引起的低容量性低钠血症。